风邪的性质和致病特点是
A. 重浊黏滞
B. 干涩伤津
C. 凝滞收引
D. 轻扬开泄
E. 耗气伤津

正确答案：D。轻扬开泄

解析：风为阳邪，轻扬开泄（D对），易袭阳位，其性善行而数变，风性主动，为百病之长。湿为阴邪，易伤阳气，易阻气机，其性重浊粘滞，湿性趋下，易袭阴位（A错）。燥性干涩，易伤津液，燥易伤肺（B错）。寒为阴邪，易伤阳气，其性凝滞主痛，性收引（C错）。暑邪与火邪均为阳邪，均伤津耗气（E错）。